男，28岁，屠宰工。高热，寒战，右臂外侧有一个1cmx3cm的表浅溃疡，溃疡表面有凹陷的黑色焦痂。溃疡初起时为丘疹，后转为水疱，周围组织水肿，继之疱疹中心区出血性坏死，周围有成群小水疱，水肿区继续扩大。局部疼痛与压痛不显著，无脓性分泌物。根据职业特点，分析该患者最可能患的疾病是
A. 布鲁菌病
B. 恙虫病
C. 气性坏疽
D. 皮肤炭疽
E. 鼠疫

正确答案：D。皮肤炭疽